面部皮肤癌较多见的是
A. 鳞状细胞癌
B. 腺上皮癌
C. 基底细胞癌
D. 未分化瘤
E. 淋巴上皮癌

正确答案：C。基底细胞癌

解析：本题考查较多见的面部皮肤癌。颜面部皮肤癌多发生于鼻部、鼻唇皱折、眼脸、上下唇、颊、耳及额部皮肤。基底细胞癌（C对）在面部皮肤癌最为多见，其次为鳞状细胞癌（A错），腺上皮癌（B错）、未分化瘤（D错）和淋巴上皮癌（E错）较为少见。